大枣的功效是
A. 益气生津
B. 补中气
C. 养血
D. 安神
E. 调和营卫

正确答案：B、C、D。补中气；养血；安神

解析：本题考查的是大枣的功效。大枣的功效是补中气（B对）、养血（C对）与安神（D对）。大枣：【功效】补中益气，养血安神，缓和药性。五味子：【功效】收敛固涩，益气生津（A错），滋肾宁心。桂枝配白芍：桂枝辛甘性温，功能发表助阳、温通经脉；白芍酸甘微寒，功能养血敛阴止汗。两药相配，收散并举，共奏调和营卫（E错）、散风敛营、解肌发表之功，治风寒表虚有汗每用。